医疗用毒性药品处方保存期限是
A. 至少2年
B. 至少5年
C. 至少1年
D. 至少3年

正确答案：A。至少2年

解析：本题考查的是医疗机构处方保存期限。医疗用毒性药品处方保存期限是至少2年（A对）。处方由调剂处方药品的医疗机构妥善保存。普通处方、急诊处方、儿科处方保存期限为1年（C错），医疗用毒性药品处方保存期限为2年。医疗机构应当对麻醉药品和精神药品处方进行专册登记，加强管理。麻醉药品处方至少保存3年（D错），精神药品处方至少保存2年。